男，40岁，头痛、偶伴间断喷射样呕吐3个月，癫痫发作1次，近1周来头痛症状加重，查体：P56次/分，BP160/95mmHg。双侧视神经乳头水肿，眼底可见出血，右眼外展不全。临床诊断为颅内压增高，其最有价值的诊断依据是
A. 剧烈头痛
B. 癫痫发作
C. 喷射样呕吐
D. 右侧外展神经麻痹
E. 视神经乳头水肿

正确答案：E。视神经乳头水肿

解析：中年男性患者，头痛症状加重，双侧视神经乳头水肿，眼底可见出血，右眼外展不全，为慢性颅内压增高，其最有价值的诊断依据是视神经乳头水肿（E对），其发生是由于颅内压增高影响视网膜中央静脉和淋巴回流所致（P31）。